下列情况不属于外源化学物对机体的损害作用的是
A. 代偿作用降低
B. 易感性增加
C. 易感性降低
D. 对外界环境应激的反应能力降低

正确答案：C。易感性降低

解析：本题考查外源化学物对机体的损害作用。外源化学物是指存在于人类环境中、可能与机体接触并进入机体，在体内呈现一定的生物学效应的一些化学物质。其对机体的损害作用主要有：代偿作用降低（A对）；易感性增加（B对）；对外界环境应激的反应能力降低（D对）。易感性降低（C错，为本题正确答案）不属于外源化学物对机体的损害作用。